以下属于窝洞制备的步骤的是
A. 扩大开口进入龋洞
B. 设计并制备洞形
C. 检查、修整、清洁窝洞
D. 去除龋坏牙本质
E. 以上均包括

正确答案：E。以上均包括

解析：窝洞制备的步骤中包括：扩大开口进入龋洞、去除龋坏牙本质、设计并制备洞形、检查、修整、清洁窝洞。掌握“银汞充填术窝洞制备、干燥及充填”知识点。